说明鱼体绝对新鲜的K值范围为
A. K≥20%
B. K≤20%
C. K≥30%
D. K≤30%
E. K≥40%

正确答案：B。K≤20%